高血压伴支气管哮喘患者禁用
A. 螺内酯
B. 氨氯地平
C. 氢氯噻嗪
D. 维拉帕米缓释剂
E. 美托洛尔

正确答案：E。美托洛尔

解析：美托洛尔（E错，为本题正确答案）为选择性β₁受体阻滞剂，对引起支气管舒张的β₂受体作用较弱，增加呼吸道阻力作用较轻，但对哮喘患者仍需慎用（九版药理学P94）。高血压伴支气管哮喘患者应该禁用非选择性β受体阻滞剂，如普萘洛尔等，但本题并无此选项，因此美托洛尔为最佳选项。螺内酯（保钾利尿剂）（A对）和氢氯噻嗪（噻嗪类）（C对）都属于利尿剂，降压作用主要通过排钠，减少细胞外容量，降低外周血管阻力，支气管支气管哮喘患者并无不利影响。氨氯地平（二氢吡啶类）和维拉帕米缓释剂（非二氢吡啶类）都属于钙通道阻滞剂，其中氨氯地平（B对）主要缺点是开始治疗时有反射性交感活性增强，引起心率增快、面部潮红、头痛、下肢水肿等，慎用于重度主动脉瓣狭窄和心室率较快的患者。维拉帕米缓释剂（D对）抑制心肌收缩和传导功能，不宜应用于心力衰竭、窦房结功能低下或心脏传导阻滞患者（P255）。